患者男，20岁。1周来发热，食欲减退，厌油，恶心呕吐，尿黄，并出现黄疸，上述症状呈进行性加重，近2天出现嗜睡，烦躁不安，伴牙龈出血，皮下淤斑，肝脾未扪及，凝血酶原活动度35%。该病人首先应考虑的诊断的是
A. 急性肝炎
B. 中毒性肝炎
C. 急性重型肝炎
D. 淤胆型肝炎
E. 慢性肝炎

正确答案：C。急性重型肝炎

解析：急性重型肝炎又称暴发型肝炎，发病多有诱因。以急性黄疸型肝炎起病，但病情发展迅猛，2周内出现极度乏力，严重消化道症状，出现神经、精神症状，表现为嗜睡、性格改变、烦躁不安、昏迷等，体检可见扑翼样震颤及病理反射，肝性脑病在Ⅱ度以上（按Ⅳ度划分）。黄疸急剧加深，胆酶分离，肝浊音界进行性缩小，有出血倾向，PTA小于40%，血氨升高，出现中毒性鼓肠，肝臭，急性肾衰竭（肝肾综合征）。即使黄疸很轻，甚至尚未出现黄疸，但有上述表现者，应考虑本病的诊断（C对）。